关于切牙的临床应用解剖，下列说法错误的是
A. 上颌切牙位于牙弓前部，易受创伤
B. 上颌切牙缺损后对发音和美观都有直接影响
C. 上颌切牙邻面接触区为龋病的好发部位
D. 只有上颌侧切牙邻面接触区为龋病的好发部位
E. 下颌切牙不易发生龋齿

正确答案：D。只有上颌侧切牙邻面接触区为龋病的好发部位

解析：本题考查切牙的应用解剖。只有上颌侧切牙邻面接触区为龋病的好发部位（D错，为本题正确答案）不符合切牙的临床应用解剖特点，切牙的邻面接触区及上颌侧切牙的舌窝顶端都是为龋病的好发部位。切牙的应用解剖主要有：1.上颌中切牙位于牙弓前部，易因外伤而折断或脱落（A对），缺损后对发音和面容美观有直接影响（B对）。2.切牙的邻面接触区及上颌侧切牙的舌窝顶端，因自洁作用差，常为龋病的好发部位（C对）；而下颌切牙舌侧接近下颌下腺管开口处，发生龋坏概率小（E对），但舌侧颈部易发生牙结石沉积。3.上颌中切牙之间偶有额外牙，应及时拔除，以免造成牙列拥挤及咬合关系紊乱；上颌侧切牙常发生变异如锥形侧切牙，也偶有上颌侧切牙先天缺失者。4.上颌中切牙牙根直且圆，牙拔除时可使用旋转力；上颌侧切牙牙根可有弯曲，牙拔除时应仔细；下颌切牙的牙根扁而窄长，牙拔除时不宜使用旋转力。